前庭蜗器包括
A. 骨半规管、前庭和耳蜗
B. 鼓室、乳突小房和咽鼓管
C. 外耳道、鼓膜、咽鼓管
D. 外耳、中耳和内耳
E. 外耳、鼓室和内耳

正确答案：D。外耳、中耳和内耳

解析：外耳、中耳和内耳3部分组成耳，即前庭蜗器（D对）。